营养不良儿皮下脂肪消减最先出现在
A. 腹部
B. 面部
C. 躯干
D. 大小腿外侧
E. 臀部

正确答案：A。腹部

解析：本题考查皮下脂肪层消耗的顺序。体重不增是营养不良的早期表现。随营养失调日久加重，体重逐渐下降，主要表现为消瘦。皮下脂肪层厚度是判断营养不良程度的重要指标之一。皮下脂肪层消耗的顺序首先是腹部（A对），其次为躯干（C错）、臀部（E错）、四肢（D错）最后为面颊（B错）。